适合于分析比较不同个体的心功能评价指标
A. 每搏输出量
B. 射血分数
C. 心指数
D. 射血量
E. 心脏做功量

正确答案：C。心指数

解析：人在安静时的心输出量与体表面积成正比，不同个体由于体表面积不同，心输出量不同，心指数为单位体表面积（m2）的心输出量，所以适合于分析比较不同个体的心功能评价指标是心指数（C对）。每搏输出量（A错）、射血分数（B错）、射血量（D错）和心脏做功量（E错）均与体表面积无关，不适合用于分析不同个体的心功能。